男性，45岁，腹胀、呕吐已半年，多于午后发作，吐出隔夜食物，吐量较大，吐后舒服，由于长期呕吐除脱水外还会造成
A. 低氯、高钾性碱中毒
B. 低氯、低钾性碱中毒
C. 低氯、高钾性酸中毒
D. 低氯、低钾性酸中毒
E. 低钾性酸中毒

正确答案：B。低氯、低钾性碱中毒

解析：长期呕吐除脱水外会造成低氯、低钾性碱中毒（B对）。长期呕吐造成胃液丧失过多，可丧失大量的H⁺及Cl⁻。肠液中的HCO₃⁻未能被胃液的H⁺所中和，HCO₃⁻被重吸收入血，使血浆HCO₃⁻增高。另外，胃液中Cl⁻大量丢失，使肾近曲小管的Cl⁻相应的减少，为维持离子平衡，代偿性地重吸收HCO₃⁻增加，导致碱中毒。大量胃液的丧失也丢失了Na⁺，在代偿过程中，K⁺和Na⁺的交换、H⁺和Na⁺的交换增加，即保留了Na⁺，但排出了K⁺及H⁺，造成低钾血症和碱中毒。